药物警戒的工作内容有
A. 药品不良反应监测
B. 上报用药差错
C. 药品价格监测
D. 上报治疗失败
E. 注意已知的不良反应发生率异常上升

正确答案：A、B、D、E。药品不良反应监测；上报用药差错；上报治疗失败；注意已知的不良反应发生率异常上升

解析：本题考查药物警戒的内容。药物警戒的工作内容有药品不良反应监测（A对）、上报用药差错（B对）、上报治疗失败（D对）、注意已知的不良反应发生率异常上升（E对）。药品价格检测（C错）不属于药物警戒。